35周婴儿，出生体重1.5kg，生后3天体温不升，需置暖箱，该暖箱适宜的温度是
A. 35℃
B. 34℃
C. 33℃
D. 32℃
E. 31℃

正确答案：B。34℃

解析：出生10天以后的1kg婴儿，出生10天内的1.5kg婴儿和出生2天内的2kg婴儿置于34℃暖箱中（B对）；出生10天内的1kg新生儿应置于35℃的暖箱中（A错）；出生3周以后的1kg婴儿、出生10天以后的1.5kg婴儿、出生2天以后的2kg婴儿和初生2天内〉2.5kg的婴儿应置于33℃的暖箱中（C错）；出生5周以后的1kg婴儿、出生4周以后的1.5kg婴儿、出生3周以后的2kg婴儿和出生2天以后的〉2.5kg的婴儿应置于32℃的暖箱中（D错）。